砷盐检查法中，醋酸铅棉花的作用是
A. 消除铅对检查的干扰
B. 消除锑对检查的干扰
C. 消除铁对检查的干扰
D. 消除氯化氢气体对检查的干扰
E. 消除硫化物对检查的干扰

正确答案：E。消除硫化物对检查的干扰